每学期刚开始，老师总会安排一些容易的课程，作业也很少，这正符合大脑皮层的
A. 始动调节
B. 动力定型
C. 优势法则
D. 保护性抑制
E. 镶嵌式活动

正确答案：A。始动调节